下列中不属于环境内分泌干扰物的是
A. 邻苯二甲酸酯类
B. 多氯联苯
C. 双酚A
D. 汞
E. 氰化物

正确答案：E。氰化物

解析：本题考查环境内分泌干扰物。内分泌干扰化学物是对维持机体内环境稳态和调节发育过程的体内天然激素的生成、释放、转运、代谢、结合、效应造成严重影响的一类外源性物质。已被证实或疑为具有内分泌干扰作用的环境化学物质有数百种，包括邻苯二甲酸酯类（A对）、多氯联苯类（B对）、有机氯杀虫剂、烷基酚类、双酚化合物类（C对）、植物和真菌激素、重金属类（D对）等。氰化物（E错，为本题正确答案）不属于环境内分泌干扰物。